易于在乳剂中排出的弱碱性抗生素
A. 四环素
B. 红霉素
C. 青霉素
D. 氯霉素
E. 头孢唑林

正确答案：B。红霉素

解析：本题考查抗生素的代谢。药物的解离度越低，乳汁中药物浓度也越低。弱碱性药物（如红霉素）（B对）易于在乳汁中排泄，而弱酸性药物（如青霉素）较难排泄。